关于生长发育评价方法，下列哪项描述是错误的
A. 身高标准体重可以反映儿童现时营养状况
B. 百分位数法的原理和制作过程与离差法基本相似
C. 离差法通常只用于等级评价法
D. 发育年龄是以某些指标的平均发育水平和变异来评价儿童的发育状况
E. 相关回归法既能评价发育水平，又能反映发育的匀称程度

正确答案：D。发育年龄是以某些指标的平均发育水平和变异来评价儿童的发育状况